男性，60岁。左上肢摔伤，急诊来院。X线摄片显示肱骨干横行骨折，并有移位，经手法复位不理想，后改为牵引治疗，又经X线影像见骨折端有分离。其最可能的后果是
A. 桡神经损伤
B. 肩关节强直
C. 肘关节僵直
D. 损伤性骨化
E. 骨折不愈合

正确答案：E。骨折不愈合

解析：老年男性患者。左上肢摔伤，急诊来院。X线摄片显示肱骨干横行骨折，并有移位，经手法复位不理想，后改为牵引治疗（提示治疗过程较长），又经X线影像见骨折端有分离（骨折不愈合典型征象），故其最可能的后果是骨折不愈合（E对）。桡神经损伤一般有垂腕表现（A错）。肩关节强直一般见于病肢长时间固定，静脉和淋巴回流不畅所引起，且患者无肩关节损伤表现（B错）。肘关节僵直一般可见于肘关节长期固定，静脉和淋巴回流不畅所引起（C错）。损伤性骨化一般由于关节扭伤、脱位或关节附近骨折，骨膜剥离形成骨膜下血肿，处理不当使血肿扩大，血肿机化并在关节附近软组织内广泛骨化，造成严重关节活动功能障碍（D错）。